正常人白天工作时出现的脑电波应为
A. α波
B. β波
C. θ波
D. δ波
E. 以上均不是

正确答案：B。β波